形成Na⁺、K⁺在细胞内外不均衡分布的原因是
A. 安静时K⁺比Na⁺更易穿透过细胞膜
B. 兴奋时Na⁺比K⁺更易穿透过细胞膜
C. K⁺的不断外流和Na⁺的不断内流
D. 膜上载体和通道蛋白的共同作用
E. 膜上Na⁺-K⁺依赖式ATP酶的活动

正确答案：E。膜上Na⁺-K⁺依赖式ATP酶的活动

解析：细胞膜内外Na⁺和K⁺浓度差是细胞发生电活动的基础，形成Na⁺、K⁺在细胞内外不均衡分布的原因是膜上Na⁺-K⁺依赖式ATP酶的活动（E对）。Na⁺-K⁺依赖式ATP酶（钠泵）每分解一分子ATP可逆浓度差将3个Na⁺移出胞外，将2个K⁺移入胞内，使细胞外液中的Na⁺浓度达到胞质内的10倍左右，细胞内的K⁺浓度达到细胞外液的30倍左右。安静时K⁺比Na⁺更易穿透过细胞膜（A错）是静息电位产生的机制。兴奋时Na⁺比K⁺更易穿透过细胞膜（B错）是动作电位产生的机制。K⁺的不断外流和Na⁺的不断内流（C错）可减小Na⁺、K⁺在细胞内外的不均衡分布。膜上载体和通道蛋白的共同作用（D错）与易化扩散有关。